我国规定，海水鱼虾的挥发性盐基总氮不得超过
A. 50mg/100g
B. 40mg/100g
C. 30mg/100g
D. 20mg/100g
E. 10mg/100g

正确答案：C。30mg/100g

解析：本题考查我国规定的海水鱼虾的挥发性盐基总氮量。挥发性盐基总氮指食品水浸液在碱性条件下能与水蒸气一起蒸馏出来的总氮量。我国规定，海水鱼虾的挥发性盐基总氮不得超过30mg/100g（C对ABDE错）。